职业卫生工作的基础是
A. 职业性有害因素的识别
B. 职业性有害因素的评价
C. 职业性有害因素的预防
D. 职业性有害因素的控制
E. 职业性有害因素的监测

正确答案：A。职业性有害因素的识别